男，70岁，2年来经常不能完整叙述新近发生的事情，且常常无中生有地讲述一些从未发生过的事情，患者意识清楚，常搞错时间和地点，最可能的症状是
A. 急性脑综合征
B. 脑衰弱综合征
C. 遗忘综合征
D. 精神自动症
E. 紧张综合征

正确答案：C。遗忘综合征

解析：老年男性患者，近事记忆减退，出现视空间障碍，考虑诊断为AD（阿尔茨海默病），症状表现为遗忘综合征。